推行临床科学合理用血的最主要目的描述正确的是
A. 减少临床用血量
B. 降低患者医疗费用
C. 保护血液资源
D. 避免输血风险
E. 减轻采供血机构压力

正确答案：C。保护血液资源

解析：医疗机构临床用血，是指输血治疗的活动。为加强医疗机构临床用血管理，推进临床科学合理用血,保护血液资源，保障临床用血安全和医疗质量，2012年6月7日卫生部发布了《医疗机构临床用血管理办法》，自2012年8月1日起施行。掌握“医疗机构临床用血管理、及法律责任”知识点。